女性，35岁。近2个月来发热，乏力伴消瘦。体检：左颈、二侧腋窝和腹股沟部位可触及数个黄豆和蚕豆大小淋巴结，肝未及，脾肋下3cm，红细胞4.0✕10¹²/L，血红蛋白12g/L，白细胞5.6✕10⁹/L，血小板150✕10⁹/L，血沉80mm/h。如果骨髓检查正常，胸部X线检查阴性，B超肝区检查正常，患者的临床分期应是
A. Ⅱ期A
B. Ⅱ期B
C. Ⅲ期A
D. Ⅲ期B
E. Ⅳ期A

正确答案：D。Ⅲ期B